可用于吗啡中毒解救的药物是
A. 苯甲酸钠咖啡因
B. 纳洛酮
C. 阿托品
D. 氟马西尼
E. 溴吡斯的明

正确答案：B。纳洛酮

解析：本题考查纳洛酮。纳洛酮（B对）可用于吗啡中毒的解救；苯甲酸钠咖啡因（A错）又称安钠咖，为强心利尿药；阿托品（C错）用于有机磷农药中毒的解毒治疗；氟马西尼（D错）用于苯二氮䓬类药物过量或中毒的解救；溴吡斯的明（E错）可用于重症肌无力、术后腹气胀或尿潴留以及对抗非去极化型肌松药的肌松作用。